关于三羧酸循环过程的叙述正确的是
A. 循环一周生成4对NADH
B. 循环一周可生成2ATP
C. 乙酰CoA经三羧酸循环转变成草酰乙酸
D. 循环过程中消耗氧分子
E. 循环一周生成2分子CO₂

正确答案：E。循环一周生成2分子CO₂

解析：柠檬酸循环的总反应为CH₃CO～SCoA+3NAD⁺+FAD+GDP+Pi+2H₂O→2CO₂+3NADH+3H⁺+FADH₂+HS-CoA+GTP，循环一周生成3对NADH（A错）、1对FADH₂、1分子GTP和2分子CO₂（E对），循环过程不消耗氧分子（D错）。由于NADH+H⁺的氢传递给氧时可生成2.5分子ATP，FADH₂的氢被氧化时可生成1.5分子ATP，再加上循环过程中底物水平磷酸化生成的1分子GTP，故1分子乙酰CoA经三羧酸循环彻底氧化分解共生成10ATP（B错）。三羧酸循环的各中间产物在反应前后质量不发生改变，因此乙酰CoA经三羧酸循环不能转变成草酰乙酸（C错）或其他的中间产物。